青少年牙周炎患者的外围血中，常可查见
A. 白细胞的趋化和吞噬功能降低
B. 白细胞的数量减少
C. 血小板凝集功能障碍
D. 淋巴细胞数量异常
E. 以上都是

正确答案：A。白细胞的趋化和吞噬功能降低

解析：本题考查青少年牙周炎（局限型侵袭性牙周炎）的病因。新分类中的侵袭性牙周炎包括了青少年牙周炎。有一些早期研究表明侵袭性牙周炎患者有周缘血的中性粒细胞和单核细胞的趋化功能降低（A对）现象。粒细胞缺乏症的血象显示白细胞的数量减少（B错）。血有病患者的血象可见血小板凝集功能障碍（C错）。病毒感染时可见淋巴细胞数量异常（D错）。